不属于感染性疾病的是
A. 带状疱疹
B. 复发性疱疹性口炎
C. 口腔结核
D. 雪口
E. 大疱性类天疱疮

正确答案：E。大疱性类天疱疮

解析：本题考查口腔黏膜感染性疾病。大疱性类天疱疮（E错，为本题的正确答案）属于自身免疫大疱性疾病。口腔黏膜感染性疾病包括单纯疱疹、带状疱疹（A对）、口腔念珠菌病、口腔结核（C对）等。复发性疱疹性口炎（B对）是由Ⅰ型单纯疱疹病毒引起的病毒感染性疾病，属于单纯疱疹。雪口（D对）是由口腔念珠菌感染引起真菌感染性疾病。